循环系统实现其对体温调节的作用，主要是通过改变
A. 脑血液温度
B. 心输出量
C. 内脏血流阻力
D. 肌肉血流速度
E. 皮肤血流量

正确答案：E。皮肤血流量